给机体输注外源性的免疫分子治疗肿瘤方法称为
A. 主动免疫治疗
B. 被动免疫治疗
C. 非特异性免疫治疗
D. 特异性免疫治疗
E. 以上说法均正确

正确答案：B。被动免疫治疗

解析：给机体输注外源性的免疫分子或免疫细胞治疗肿瘤的方法被称为肿瘤的被动免疫治疗。掌握“肿瘤免疫”知识点。